修复肯氏第四类牙列缺损，下前牙咬于硬腭黏膜时，哪种设计为好
A. 磨除下前牙切端使有2mm空隙
B. 在义齿上前牙区基托附平面导板
C. 在义齿的上磨牙区作牙合垫
D. 拔除下前牙后，上下前牙义齿修复
E. 在义齿上前牙区加斜面导板

正确答案：B。在义齿上前牙区基托附平面导板

解析：修复肯氏第四类牙列缺损，下前牙咬于硬腭黏膜时可把上腭板制成平面导板，做为永久义齿使用（B对）。在临床上一般不主张磨除下前牙切端使有2mm空隙（A错）以达到调整咬合的目的。（牙合）垫（C错）通过机械性地隔离上下牙间的直接接触，重新分配（牙合）力，缓冲咀嚼碰撞压力，当下前牙咬于硬腭黏膜时不适宜选用。拔除下前牙后，上下前牙义齿修复（D错）不符合口腔修复尽量保存牙体的原则，不宜选用。斜面导板适用于上颌正常、下颌后缩的远中错牙合，在义齿上前牙区加斜面导板（E错）也不适宜解决下前牙咬于硬腭黏膜的情况。